应与颞下颌关节紊乱病相鉴别的疾病是
A. 类风湿关节炎
B. 创伤性关节炎
C. 化脓性关节炎
D. 髁突骨瘤
E. 以上说法均正确

正确答案：E。以上说法均正确

解析：本题考查颞下颌关节紊乱病。应与颞下颌关节紊乱病相鉴别的疾病是类风湿关节炎（A对）、创伤性关节炎（B对）、化脓性关节炎（C对）、髁突骨瘤（D对）。综上，选E。颞下颌关节紊乱鉴别诊断：有时需与类风湿关节炎、创伤性关节炎、化脓性关节炎、髁突骨瘤及骨软骨瘤等进行鉴别。